反映毒物所致病损的指标是
A. 尿酚
B. 尿ALA
C. 肝功能
D. 现场空气中毒物浓度
E. 有害作业工龄

正确答案：C。肝功能